初产妇，28岁。妊娠40周临产，规律宫缩12小时，阴道流液8小时。阴道检查：宫口7cm，先露+1，下列诊断正确的是
A. 潜伏期延长
B. 滞产
C. 第一产程延长
D. 正常活跃期
E. 胎膜早破

正确答案：D。正常活跃期

解析：初产妇总产程包括第一产程潜伏期→第一产程活跃期→第二产程→第三产程，第一产程潜伏期指从临产出现规律宫缩至宫口扩张3cm，一般需要8小时，超过16小时为潜伏期延长；第一产程活跃期是指宫口开大3-10cm，一般需要4小时，超过8小时称为活跃期延长。该产妇规律宫缩12小时，宫口开7cm，已经进入第一产程活跃期（D对A错），初产妇第一产程正常需11～20小时（C错）。滞产（B错）总产程超过24小时。胎膜早破（E错）是临产前发生胎膜破裂，该产妇规律宫缩12小时，阴道留液8小时，属于正常胎膜破裂。